一个大样本成年男性舒张压测量资料的均数与中位数均是83mmHg，标准差是12.25mmHg，则
A. 理论上有95%成年男子的舒张压在59～107mmHg之间
B. 30～69岁男子的舒张压总体均数95%的可信区间为59～107mmHg
C. 理论上有5%成年男子的舒张压超过107mmHg
D. 理论上有5%成年男子的舒张压低于59mmHg
E. 理论上有5%成年男子的舒张压≤83mmHg

正确答案：A。理论上有95%成年男子的舒张压在59～107mmHg之间